某大型国营公司筹集到一批经费，准备对整个企业职工的职业危害因素接触情况及健康状况进行调查，分析有害因素的接触与人体健康的关系，提出相应的职业危害防护措施。具体采取的调查方法是
A. 横断面调查
B. 病例对照研究
C. 队列研究
D. 典型抽样调查
E. 随机抽样调查

正确答案：A。横断面调查